与可摘局部义齿稳定无关的是
A. 翘动
B. 弹跳
C. 摆动
D. 旋转
E. 移位

正确答案：B。弹跳

解析：本题考查义齿不稳定的临床表现。弹跳（B错，为本题的正确答案）多见于卡环臂在导线上或基牙的非倒凹区，或卡环尖端置于邻牙上形成支点，义齿不能完全就位，所以与义齿的稳定无关。可摘局部义齿的稳定是指义齿在行使功能过程中不翘动（A对）、不摆动（C对）、不旋转（D对）、不下沉等。可摘局部义齿的固位是指义齿在口腔内就位后，不因唇颊舌肌生理运动、食物黏着及重力作用而向牙合向或就位道相反方向脱位，即发生义齿移位。一个固位好的义齿，其稳定性也应很好。所以，移位（E对）也与可摘局部义齿的稳定有关。